当归主产于
A. 四川省
B. 青海省
C. 甘肃省
D. 陕西省
E. 山西省

正确答案：C。甘肃省

解析：本题考查的是当归的产地。当归主产于甘肃省（C对）。当归：【产地】主产于甘肃岷县、武都、漳县、成县、文县等地；湖北、云南、四川（A错）等省也产。主产于青海省（B错）的药材有大黄、羌活、秦艽等。主产于陕西省（D错）的药材有藁本、茜草、淫羊藿、南五味子、沙苑子、茵陈、猪苓等。主产于山西省（E错）的药材有苦参、黄芪、远志、党参、香加皮、连翘、蒲公英、硫黄等。